因可提高血液携氧量，被长跑运动员用于提高成绩，因而被列为兴奋剂管理的药物是
A. 甲睾酮
B. 可卡因
C. 哌替啶
D. 人促红素
E. 麻黄碱

正确答案：D。人促红素

解析：本题考查兴奋剂。人促红素（D对）因可提高血液携氧量，被长跑运动员用于提高成绩，因而被列为兴奋剂管理。甲睾酮（A错）属于具有蛋白同化作用的药物。可卡因（B错）属于精神刺激剂。哌替啶（C错）属于麻醉药品，能够让运动员长时间忍受肌肉疼痛。麻黄碱（E错）属于药品类易制毒化学用品。